下列情况中，不能行胃癌根治手术的是
A. 子宫直肠窝转移
B. 肝十二指肠韧带内淋巴结转移
C. 脾门部淋巴结转移
D. 癌组织浸润胰尾部时
E. 癌组织浸润横结肠时

正确答案：A。子宫直肠窝转移

解析：子宫直肠窝转移是胃癌晚期的表现，原发灶已经无法切除，不能行根治性手术，只能行姑息性手术（A错，为本题正确答案）。胃癌的区域淋巴结可分为三站，胃癌根治手术时淋巴结清除范围以D表示，第一站淋巴结未全部清除者为D0，第三站淋巴结全部清除为D3术，肝十二指肠韧带内淋巴结是胃第十二组淋巴结，属于第三站淋巴结，所以肝十二指肠韧带内淋巴结转移可施行D3根治术（B对）。胃癌伴脾门淋巴结转移（C对）、胰体、胰尾浸润（D对）等，可施行扩大的胃癌根治术，指包括胰体、尾及脾脏在内的根治性胃大部切除术或全胃切除术。胃癌浸润肝、横结肠时，可行联合脏器切除术（E对）。